酸不收敛湿邪，温不燥烈伤阴的药是
A. 白芍
B. 栀子
C. 木瓜
D. 五味子
E. 鹿衔草

正确答案：C。木瓜

解析：本题考查的是木瓜的性能特点。酸不收敛湿邪，温不燥烈伤阴的药是木瓜（C对）。木瓜：【性能特点】本品酸温，祛邪扶正两相兼，舒筋祛湿生津而不燥不敛，酸生津而不敛湿邪，温化湿而不燥烈伤阴。入肝经，益筋血而平肝舒筋；入脾经，生津开胃、祛湿和中。治湿痹与脚气浮肿最宜，治吐泻转筋、血痹肢麻与津亏食少可投。白芍（A错）：【性能特点】本品甘补酸敛，苦微寒兼清泄，入肝、脾经。既养血调经、柔肝止痛，又敛阴止汗、平抑肝阳，略兼清热，主治阴血亏虚、肝脾不和、肝阳上亢诸证，兼治体虚多汗等证。栀子（B错）：【性能特点】本品苦寒降泄清利，入心、肺、三焦经。既清心肺三焦之火而泻火除烦解毒、凉血止血，又清利膀胱湿热与清泻滑利大肠，导湿热火毒外出，利小便、缓通便、退黄疸。捣烂外敷能散瘀血而消肿止痛。药力较缓，虽味苦而不燥湿，但能缓泻。既走气分，能清泻气分热；又走血分，能清泄血分热。清热泻火不如石膏，长于凉血解毒、退黄、止血、滑利二便。五味子（D错）：【性能特点】本品酸敛质润温补，敛、补兼备，入肺、肾、心经。上能敛肺止咳平喘，下能滋肾涩精止泻，内能生津宁心安神，外能固表收敛止汗。五味俱备，唯酸独胜；虽曰性温，但质滋润；敛补相兼，节流增源。药力较强，为补虚强壮收涩之要药。鹿衔草（E错）：【性能特点】本品苦能燥泄，甘温补虚。入肝、肾经，能祛除风湿、强健筋骨、调经止血；入肺经，能补肺止咳，民间常用。